记录神经纤维动作电位时，加入选择性离子通道阻断剂河豚毒，会出现什么结果
A. 静息电位变小
B. 静息电位变大
C. 除极相不出现
D. 超射不出现
E. 复极相延缓

正确答案：C。除极相不出现